患者眩晕，头重昏蒙，或伴视物旋转，胸闷恶心，呕吐痰涎，食少多寐，舌苔白腻，脉濡滑，其证候是
A. 肝阳上亢证
B. 气血亏虚证
C. 肾精不足证
D. 痰湿中阻证
E. 瘀血阻络证

正确答案：D。痰湿中阻证

解析：题中患者为眩晕。痰浊蒙蔽清阳则头重昏蒙，或伴视物旋转；痰浊中阻，浊阴不降，气机不利则胸闷恶心，呕吐痰涎；脾阳不振则食少多寐；舌苔白腻，脉濡滑均为痰浊内蕴所致。以上证候属于痰浊中阻证（D对）。肝阳上亢证之眩晕的主要表现为眩晕，耳鸣，头目胀痛，口苦，失眠多梦，遇烦劳郁怒而加重，急躁易怒等（A错）。气血亏虚证之眩晕的主要表现为眩晕动则加剧，劳累即发，面色㿠白，神疲乏力，倦怠懒言，唇甲不华等（B错）。肾精不足证之眩晕的主要表现为眩晕日久，精神萎靡，腰膝酸软，少寐多梦，健忘，两目干涩，视力减退，遗精，泄泻，耳鸣，齿摇等（C错）。瘀血阻络证之眩晕的主要表现为眩晕，头痛，兼见健忘，失眠，心悸，面唇紫暗，舌暗有瘀斑等（E错）。